生产场所噪声强度最大不得超过
A. 80dB（A）
B. 85dB（A）
C. 90dB（A）
D. 100dB（A）
E. 115dB（A）

正确答案：E。115dB（A）